下列哪项不是子宫腺肌病的病因
A. 多次妊娠
B. 分娩时子宫壁创伤
C. 慢性子宫内膜炎
D. 高雌激素刺激
E. 慢性盆腔炎

正确答案：E。慢性盆腔炎

解析：子宫腺肌病的病因多认为由于子宫内膜基底层缺乏粘膜下层，基底层内膜细胞侵入子宫肌层所致，可能由于遗传因素以及多次妊娠（A对）和分娩时子宫壁的创伤（B对）、慢性宫内膜炎（C对）或高水平雌孕激素（D对）使基底层子宫内膜侵入肌层为患。慢性盆腔炎（E错，为本题正确答案）不是子宫腺肌病的病因。